婴儿从母体获得的抗体开始消失的月龄是
A. 1～2月以后
B. 3～4月以后
C. 5～6月以后
D. 7～8月以后
E. 9～10月以后

正确答案：B。3～4月以后

解析：出生3～4月以后（B对）婴儿从母体获得的抗体开始消失。